某县城有6所小学，5所初中和3所高中：所属乡镇有10所中心小学，24所村小学和6所初中。该县疾病预防控制中心学校卫生科为了观察本县学生的生长发育动态拟开展调查。监测内容不包括
A. 身高体重
B. 肺活量
C. 立定跳远
D. 文化程度
E. 因病缺课情况

正确答案：D。文化程度